窦房结细胞动作电位0期去极的离子基础是
A. Ca²⁺内流
B. Na⁺内流
C. K⁺内流
D. Ca²⁺外流
E. K⁺外流

正确答案：A。Ca²⁺内流